属于可引起慢性复发性腮腺炎病因的是
A. 细菌逆行感染
B. 先天性发育异常
C. 自身免疫功能异常
D. A+B
E. A+B+C

正确答案：E。A+B+C

解析：慢性复发性腮腺炎病因：①先天性发育异常：该病有遗传倾向，有的患者有典型家族史。腺体的先天性发育异常成为潜在的发病因素。②自身免疫功能异常：有的患者伴有其他免疫学指标的异常，因而认为本病为自身免疫性疾病，在此基础上继发感染。③细菌逆行感染：许多患儿腮腺肿胀发作与上呼吸道感染及口腔内炎性病灶相关，细菌一通过腮腺导管逆行感染。成人复发性腮腺炎为儿童复发性腮腺炎迁延未愈而来。掌握“慢性复发性腮腺炎”知识点。